错误的是
A. 起始于薄束核和楔束核
B. 属于上行(感觉)传导束
C. 终于丘脑腹后外侧核
D. 传导本体感觉和精细触觉
E. 其细胞体位于对侧脊髓后角

正确答案：E。其细胞体位于对侧脊髓后角

解析：内侧丘系是躯干和四肢意识性本体感觉和精细触觉传导通路中的纤维之一。躯干和四肢意识性本体感觉和精细触觉传导通路的第2级神经元胞体在薄束核和楔束核（A对E错，为本题正确选项），由此2核发出的纤维向前绕过中央灰质的腹侧，在中线上与对侧的交叉，称内侧丘系交叉，交叉后的纤维转折向上，在锥体束的背侧呈前后方向排列，行于延髓中线两侧，称内侧丘系，终于同侧丘脑腹后核（C对），是传递对侧本体觉和精细触觉（D对）冲动的纤维，属于上行(感觉)传导束（B对）。